亚砷酸盐注射液属于
A. 含特殊药品的复方制剂
B. 第一类精神药物
C. 第二类精神药物
D. 医疗用毒性药品

正确答案：D。医疗用毒性药品

解析：本题考查毒性药品的分类。现已公布的毒性药品（D对）的管理品种分为中药品种和西药品种两大类，其中亚砷酸注射液属于毒性药品西药品种。